很多药物对胎儿发育有害，除了
A. 四环素
B. 庆大霉素
C. 链霉素
D. 青霉素
E. 卡拉霉素

正确答案：D。青霉素

解析：本题考查对胎儿发育有害的药物。青霉素（D错，为本题的正确答案）毒性低，代谢快对胎儿发育影响不大。四环素（A对）、庆大霉素（B对）、链霉素（C对）和卡拉霉素（E对）均对胎儿发育有害。